男，66岁。因右侧腹股沟斜疝嵌顿9小时入院。急诊手术中发现嵌顿入疝囊的回肠有约50%坏死，行坏死回肠切除肠吻合术。对伤口进行彻底清洗后，无明显炎症表现。疝处理应首选
A. 无张力疝修补术
B. Ferguson法修补术
C. Halsted法修补术
D. Bassini法修补术
E. 单纯疝囊高位结扎术

正确答案：E。单纯疝囊高位结扎术

解析：中老年男性患者，右腹股沟斜疝嵌顿9小时（绞窄性斜疝病因），急诊手术中发现疝囊的回肠有约50%坏死（绞窄性斜疝典型表现），行坏死回肠切除肠吻合术，故考虑诊断为绞窄性斜疝，因肠坏死而局部有严重感染，通常也采取单纯疝囊高位结扎（E对）。无张力疝修补术（A错）是在无张力情况下，利用人工高分子材料网片进行修补，但修补材料的植入需严格执行无菌原则，对嵌顿疝行急诊手术不推荐使用材料，对有污染可能的手术，不推荐使用不吸收材料进行修补。Ferguson法修补术（B错）一般适用于腹横筋膜无显著缺损、腹股沟管后壁尚健全的病人，即前壁修补最常用。Halsted法修补术（C错）、Bassini法修补术（D错）一般适用于腹横筋膜松弛、腹股沟管薄弱者，但Bassini法修补术临床应用最广泛。